呕吐吞酸，胸胁胀满，嗳气频作，脘闷食少。其证候是
A. 食滞胃脘
B. 胃阴虚
C. 肝脾不调
D. 肝胃不和
E. 胃阳虚

正确答案：D。肝胃不和

解析：肝气郁结，肝失疏泄，横逆犯胃，故胸胁胀满；胃气上逆，胃失和降，故呕吐，嗳气频作；肝胃气滞，郁而化火，故吞酸；胃受纳失职，故脘闷食少，故其证候为肝胃不和（D对）证。食滞胃脘（A错）证证候表现为胃脘胀满疼痛，拒按，嗳腐吞酸，泻下不爽，肠鸣，矢气臭如败卵，大便酸腐臭秽，舌苔厚腻，脉滑。胃阴虚（B错）证临床表现为胃脘隐隐灼痛，嘈杂不舒，饥不欲食，干呕，呃逆，口燥咽干，大便干结，小便短少，舌红少苔，脉细数。肝脾不调（C错）证证候表现为胸胁胀满窜痛，腹胀纳呆，腹痛欲泻，泻后痛减，或便溏不爽，肠鸣矢气，舌苔白，脉弦或缓。胃阳虚（E错）证证候表现为胃脘冷痛，绵绵不已，喜温喜按，食后缓解，泛吐清水倦怠乏力，畏寒肢冷，舌淡胖嫩，脉沉迟无力。